男性，36岁，被火焰烧伤2小时，估计深Ⅱ度面积15%，Ⅲ度面积25%，患者入院经清创、抗休克治疗，病情稳定。对该患者应立即采取的治疗措施是
A. 补液加快，增加胶体
B. 输血及血浆
C. 联合应用有效广谱抗生素
D. 排碱纠正酸中毒
E. 尽快切除感染的焦痂与深Ⅱ°痂皮

正确答案：E。尽快切除感染的焦痂与深Ⅱ°痂皮

解析：其治疗不能仅靠支持治疗、用抗生素等，更主要的是应清创感染的焦痂，切除深Ⅱ°痂皮，引流创面，对新鲜肉芽创面移植异体皮并嵌入自体皮片。这样才能控制感染。掌握“火器伤、热烧伤”知识点。